髋关节由髋臼和股骨头构成，其运动幅度虽不及肩关节，但具有较大的稳固性以适应行走和负重的功能需要。运动关节的肌包括髋肌和部分大腿肌，分别使其作内收、外展、旋内、旋外和环转等运动。下列何者不能使髋关节内收
A. 耻骨肌
B. 长收肌
C. 股薄肌
D. 大收肌
E. 股内侧肌

正确答案：E。股内侧肌

解析：大腿肌内侧肌群包括耻骨肌（A对）、长收肌（B对）、 股薄肌（C对） 、短收肌 、 大收肌（D对）。内侧群肌作用是使髋关节内收和旋外，股内侧肌（E错，为本题正确答案）不属于大腿肌内侧肌群。